玉屏风散的功用是
A. 固表
B. 涩肠
C. 止遗
D. 固冲
E. 补肾

正确答案：A。固表

解析：玉屏风散功效为益气固表止汗，为治疗表虚自汗之基础方，方中黄芪补中益肺，实卫气而固表止汗；白术益气健脾，助黄芪补气固表止汗之力；防风祛风邪而走表，三药同用，功奏益气固表止汗之功（A对）。